紫花洋地黄苷A用温和酸水解得到的产物是
A. 洋地黄毒苷元、2分子D-洋地黄毒糖和1分子洋地黄双糖
B. 洋地黄毒苷元、2分子D-洋地黄毒糖和1分子D-葡萄糖
C. 洋地黄毒苷元、3分子D-洋地黄毒糖和1分子D-葡萄糖
D. 洋地黄毒苷元、5分子D-洋地黄毒糖和1分子D-葡萄糖
E. 洋地黄毒苷元、1分子D-洋地黄毒糖和2分子洋地黄双糖

正确答案：A。洋地黄毒苷元、2分子D-洋地黄毒糖和1分子洋地黄双糖

解析：本题考查的是温和酸水解。紫花洋地黄苷A用温和酸水解得到的产物是洋地黄毒苷元、2分子D-洋地黄毒糖和1分子洋地黄双糖（A对）。紫花洋地黄苷A经过稀酸水解得到洋地黄毒苷元、2分子D-洋地黄毒糖和1分子洋地黄双糖。